女，28岁。妊娠2个月，到某大学医院妇产科接受人工流产手术。接诊医师给患者检查时，旁边有10多位男女见习。患者要求见习医学生出去，被接诊医生拒绝。随后医师边操作边给医学生讲解。术后患者质问医师为何示教未事先告知，医师认为患者在医院无隐私，后患者以隐私权被侵犯为由，要求当地卫生行政部门进行处理。基于该案例，卫生行政部门给予当事医师警告处分。处分的依据是
A. 医师法
B. 药品管理法
C. 行政处罚法
D. 母婴保健法
E. 精神卫生法

正确答案：A。医师法

解析：本题考查医师法。女，28岁。妊娠2个月，到某大学医院妇产科接受人工流产手术。接诊医师给患者检查时,旁边有10多位男女见习。患者要求见习医学生出去，被接诊医生拒绝。随后医师边操作边给医学生讲解。术后患者质问医师为何示教未事先告知，医师认为患者在医院无隐私，后患者以隐私权被侵犯为由，要求当地卫生行政部门进行处理。基于该案例，卫生行政部门给予当事医师警告处分。处分的依据是医师法（A对）。医师在执业活动中履行的义务主要是：①遵守法律、法规，遵守技术操作规范；②树立敬业精神，遵守职业道德，履行医师职责，尽职尽责为患者服务；③关心、爱护、尊重患者，保护患者的隐私；④努力钻研业务，更新知识，提高专业技术水平；⑤宣传卫生保健知识，对患者进行健康教育。依据的是《执业医师法》。